需要嚼碎服用的药品是
A. 洋托拉唑肠溶片
B. 胰酶肠溶片
C. 乳酸菌素片
D. 胶体果胶铋胶囊
E. 法莫替丁片

正确答案：C。乳酸菌素片

解析：本题考查乳酸菌素片。乳酸菌素片（C对）为助消化药，整片吞服后在消化道内不易溶解，嚼碎后服用有利于药物在消化道内溶解吸收。洋托拉唑肠溶片（A错）和胰酶肠溶片（B错）中的肠溶性包衣使药物在肠道内定位释放，嚼碎会破坏包衣。胶体果胶铋胶囊（D错）中胶囊外壳可以起到延缓药物消化的作用，不能嚼碎。法莫替丁片（E错）为薄膜衣片，片芯之外包有薄膜衣，不能直接嚼碎。